仙灵骨葆胶囊既能滋补肝肾，又能
A. 活血通络
B. 祛风通络
C. 蠲痹通络
D. 舒筋通络
E. 除湿通络

正确答案：A。活血通络

解析：本题考查的是仙灵骨葆胶嚢的功能。仙灵骨葆胶囊既能滋补肝肾，又能活血通络（A对）。仙灵骨葆胶囊：【功能】滋补肝肾，活血通络，强筋壮骨。木瓜丸：【功能】祛风散寒（B错），除湿通络（E错）。抗栓再造丸：【功能】活血化瘀，舒筋通络（D错），息风镇痉。功能为蠲痹通络（C错）的中成药，2022年考试指南未明确说明。